属于吸入型肾上腺糖皮质激素的药物有
A. 布地奈德
B. 地塞米松
C. 氟替卡松
D. 倍氯米松
E. 泼尼松龙

正确答案：A、C、D。布地奈德；氟替卡松；倍氯米松

解析：本题考查吸入型肾上腺糖皮质激素药物。属于吸入型肾上腺糖皮质激素的药物有布地奈德（A对）、氟替卡松（C对）、倍氯米松（D对）。大多数糖皮质激素制剂可经胃肠道迅速吸收，生物利用度高，不受进食的干扰，且应用方便，故片剂为最常用的剂型。适用于在较短时间内产生疗效或中、长程治疗者。用于口服的糖皮质激素有氢化可的松、泼尼松、泼尼松龙（E错）、地塞米松（B错）等。氢化可的松琥珀酸钠，泼尼松龙琥珀酸钠、地塞米松注射剂等可供静脉注射或滴注用，可在注射后立即发生效应，适用于病情危重需迅速获得糖皮质激素者。局部外用制剂有软膏、栓剂和气雾剂等。吸入型肾上腺糖皮质激素具有局部抗炎作用强、全身不良反应少的优点，可增加患者的肺功能，降低气道高反应性，减少支气管扩张剂的应用，故而被国内外权威的哮喘诊治指南推荐为治疗哮喘的一线药物。